新斯的明属于
A. M受体激动药
B. N2受体激动药
C. N1受体激动药
D. 胆碱酯酶复活剂
E. 胆碱酯酶抑制剂

正确答案：E。胆碱酯酶抑制剂

解析：本题考查易逆性抗胆碱酯酶药。新斯的明属于胆碱酯酶抑制剂（E对）。